下列神经反射活动中，存在正反馈调节的是
A. 肺牵张反射
B. 屈肌反射
C. 排尿反射
D. 甲亢时TSH分泌减少
E. 压力感受性反射

正确答案：C。排尿反射

解析：排尿反射（C对）、分娩反射存在正反馈调节。肺牵张反射（A错）包括肺扩张反射和肺萎陷反射两种反射是指肺扩张或向肺内充气可引起吸气活动抑制，而肺萎陷或从肺内抽气则可引起吸气活动加强的现象，属于负反馈调节（P174）。屈肌反射（B错）是指当脊动物一侧肢体的皮肤受到伤害性刺激时，可反射性引起受刺激侧肢体关节的屈肌收缩而伸肌舒张，使肢体屈曲的现象，与反馈调节无关（P324）。压力感受性反射（E错）又称降压反射是指当动脉血压突然升高时，可反射性引起心率减慢、心输出量减少、血管舒张、外周阻力减小，血压下降的现象，属于负反馈调节（P131-P132）。甲亢时由于甲状腺合成释放过多的甲状腺激素会负反馈的抑制腺垂体释放TSH（促甲状腺激素）导致TSH分泌减少（D错）。